有关药物的副作用，不正确的是
A. 为治疗剂量时所产生的药物反应
B. 为与治疗目的有关的药物反应
C. 为不太严重的药物反应
D. 为药物作用选择性低时所产生的反应
E. 为一种难以避免的药物反应

正确答案：B。为与治疗目的有关的药物反应

解析：药物的副作用是由于药物的选择性低，在药物治疗剂量时产生的（A对）与治疗目的无关的作用（B错，为本题正确答案）。副作用是要药物本身固有的作用，是难以避免的（E对），通常表现较轻微（C对），例如，阿托品用于解除胃肠痉挛时，可引起口干、心悸、便秘等副作用。